规定在20℃左右的水中3分钟内崩解的片剂是
A. 肠溶片
B. 分散片
C. 泡腾片
D. 舌下片
E. 缓释片

正确答案：B。分散片

解析：本题考查片剂的崩解时限。根据片剂的质量要求，规定在20℃左右的水中3分钟内崩解的片剂是分散片（B对）；肠溶片（A错）要求在盐酸溶液中2小时内不得有裂缝、崩解或软化现象，在pH6.8磷酸盐缓冲液中1小时内全部溶解并通过筛网；泡腾片（C错）的崩解时限为5分钟；舌下片（D错）的崩解时限为5分钟；缓释片（E错）按照药典规定需要进行释放度测定，不再进行崩解时限的检查。